对特定人群中可能发生不良健康影响的严重性进行估计描述的是
A. 危害识别
B. 危害特征描述
C. 暴露评估
D. 风险特征描述
E. 风险管理

正确答案：D。风险特征描述

解析：本题考查风险特征描述。风险特征描述（D对ABCE错）是指根据危害识别、危害特征描述和暴露评估，对产生健康影响的可能性与特定人群中已发生或可能发生不良健康影响的严重性进行定性和（或）定量评估以及不确定性等综合性描述。